哮喘发作，喘息喉鸣，痰多白沫，形寒无汗，四肢不温，面色晦滞带青，其治法是
A. 补肾纳气
B. 补肺固卫
C. 健脾化痰
D. 温肺化痰，止咳平喘
E. 回阳固脱，温肺平喘

正确答案：D。温肺化痰，止咳平喘

解析：根据本病例患者“哮喘发作，喘息喉鸣”，当处于支气管哮喘发作期。根据其“痰多白沫，形寒无汗，四肢不温，面色晦滞带青”可诊断为支气管哮喘发作期之寒性哮喘，治以温肺散寒，化痰定喘，选项温肺化痰，止咳平喘（D对）最接近教材表述。补肾纳气（A错）为哮喘之肾虚不纳证的治法。补肺固卫（B错）为哮喘之肺气虚弱证的治法。健脾化痰（C错）为哮喘之脾气虚弱证的治法。回阳固脱，温肺平喘（E错）为哮喘之喘脱危证的治法。